欲了解水源水质情况，应进行
A. 毒理实验
B. 水质检验
C. 水质卫生特征测定
D. 流行病学调查
E. 水源环境卫生调查

正确答案：B。水质检验

解析：本题考查水质检验。欲了解水源水质情况，最适宜的方法就是进行水质检验（B对ACDE错）。水质检验可以直接检测水中化学物质的含量，可以反映水的纯净程度，从而判断水质的好坏。它可以检测水中的水体污染物，包括有机物、无机物、重金属和微生物等，可以检测水中的pH值、电导率和溶解氧等指标，从而判断水质是否合格。水源水质检验可以及时发现水质的变化，及时预警，以便采取应对措施，保障水质的安全。它可以检测出水中的污染物，从而识别水源的污染源，帮助我们采取有效的污染治理措施。